哺乳期妇女禁用的药品是
A. 尼美舒利
B. 骨化三醇
C. 阿司匹林
D. 头孢克洛
E. 阿莫西林

正确答案：A。尼美舒利

解析：本题考查哺乳期妇女用药。哺乳期妇女禁用的药品是尼美舒利（A对）。尼美舒利为哺乳期禁用的神经系统用药。骨化三醇（B错）、阿司匹林（C错）、头孢克洛（D错）、阿莫西林（E错）都不属于哺乳期禁用药物。